医学史上第一次卫生革命的标志是
A. 疾病从单纯治疗向群体预防发展
B. 个体预防向群体预防发展
C. 个体预防向治疗与预防相结合发展
D. 群体预防向社会医学发展
E. 疾病从单纯治疗向治疗与预防相结合发展

正确答案：E。疾病从单纯治疗向治疗与预防相结合发展

解析：疾病从单纯治疗向治疗与预防相结合发展（E对）是医学史上第一次卫生革命的标志。